不属于洛丁新（苯那普利）发挥肾保护作用主要机制的是
A. 降低血压
B. 减少蛋白尿
C. 减轻血尿
D. 减轻肾脏炎症反应
E. 抑制肾脏纤维化

正确答案：C。减轻血尿

解析：洛丁新（苯那普利）为血管紧张素转换酶抑制剂（ACEI），其发挥肾保护作用的主要机制有：①通过抑制循环和组织中血管紧张素转换酶（ACE），使血管紧张素Ⅱ（ATⅡ）生成减少，舒张外周血管起到降低血压（A对）的作用；②主要通过扩张出球小动脉，减少残余肾单位高滤过状态，减少蛋白尿（B对）的形成；③残余肾单位高滤过状态的缓解，可以减少炎性细胞的浸润和延缓肌成纤维细胞的形成，减轻肾脏炎症反应（D对），抑制肾脏纤维化（E对）。洛丁新（苯那普利）不能用于减轻血尿（C错，为本题正确答案）。